为明确诊断，最常用的方法是
A. 宫颈活检
B. 阴道镜检查
C. 分段诊刮
D. 腹腔镜检查
E. 血清肿瘤标志物测定

正确答案：C。分段诊刮

解析：该患者为老年女性，出现绝经后不规则阴道流血（子宫内膜癌的主要表现为绝经后阴道不规则流血），查体肥胖（肥胖为子宫内膜癌的高危因素）。妇检：子宫增大（晚期可有子宫增大），B型超声显示子宫内膜厚而不规则（典型子宫内膜癌的超声图像有宫腔有实质不均匀回声区，或宫腔线消失，肌层内有不均匀回声区），考虑子宫内膜癌。为明确诊断，最常用的方法是分段诊刮（C对），其能刮取子宫内膜和内膜病灶行活组织检查，作出病理检查。宫颈活检（P303）（A错）主要用于宫颈癌和癌前病变的确诊。阴道镜检查（P443）（B错）主要用于观察阴道和宫颈，对可疑部位行定位、活检，结合活检方可确诊。腹腔镜检查（D错）主要用于腹腔疾病的诊断和治疗，对子宫内膜癌的诊断价值不大。血清肿瘤标志物测定（P316）（E错）可作为肿瘤治疗疗效的观察指标，不能确诊。